一定时期内患某病的全部患者中因该病死亡者所占的比例为
A. 引入率
B. 续发率
C. 发病率
D. 病死率
E. 累积死亡率

正确答案：D。病死率